既补肾益气，又活血壮骨的中成药是
A. 颈复康颗粒
B. 骨疏康颗粒
C. 金花消痤丸
D. 防风通圣丸
E. 红药气雾剂

正确答案：B。骨疏康颗粒

解析：本题考查的是骨疏康颗粒的功能。既补肾益气，又活血壮骨的中成药是骨疏康颗粒（B对）。骨疏康颗粒：【功能】补肾益气，活血壮骨。颈复康颗粒（A错）：【功能】活血通络，散风止痛。防风通圣丸（D错）：【功能】解表通里，清热解毒。金花消痤丸（C错）与红药气雾剂（E错）的功能，2022年考试指南未明确说明。金花消痤丸：【功能】清热泻火，解毒消肿。红药气雾剂：【功能】活血逐瘀，消肿止痛。